女，30岁，持续发热10天。体检：精神萎靡，反应淡漠，体温39.5℃，心率70次/分，肝肋下未触及，脾肋下2cm。化验：WBC1.4×10⁹/L，N60%，L40%，肥达氏反应O1：80（+），H1：160（+），ALT180U/L，总胆红素22.2umol/L。为确诊应首先检查的项目是
A. 血培养
B. 骨髓培养
C. 外裴氏反应
D. 肝炎病毒血清学检测
E. 粪便培养

正确答案：A。血培养

解析：患者持续发热，表情淡漠，腹胀便秘，肝脾肿大，相对缓脉（伤寒特征性的临床表现），白细胞1.4×10⁹/L（成人正常参考值4～10×10⁹/L）减少，肥达试验阳性，故诊断伤寒可能性大。在病程第1~2周内，血培养的阳性率最高（A对）。骨髓培养（B错）在血培养阴性时可考虑，外裴氏反应（C错）用于辅助诊断，肝炎病毒血清学检测（D错）用于诊断肝炎病毒，粪便培养（E错）在病程第2周起阳性率逐渐增加，第3~4周阳性最高，可达75%。